《药品生产质量管理法规》对机构与人员严格要求，下列关于关键人员的说法正确的是
A. 质量管理负责人和生产管理负责人可以兼任
B. 质量授权人和生产管理负责人可以兼任
C. 质量管理负责人和质量授权人可以兼任
D. 质量授权人不可以独立履行职责

正确答案：C。质量管理负责人和质量授权人可以兼任

解析：本题考查药品生产质量管理规范。药品生产质量管理相关的关键人员应为企业全职人员，包括企业负责人、生产管理负责人和质量受权人。质量管理负责人和生产管理负责人不得互相兼任。质量管理负责人和质量受权人可以兼任（C对）。